患者，男，74岁，1型糖尿病30年，空腹血糖波动在2.9～9.1mmol/L，餐后2小时血糖波动在4.1～10.4mmol/L之间，该患者可长期应用的治疗药物有
A. 瑞格列奈加基础胰岛素
B. 基础胰岛素加餐时胰岛素
C. 持续皮下胰岛素泵输注
D. 艾塞那肽
E. 长效胰岛素

正确答案：B、C、E。基础胰岛素加餐时胰岛素；持续皮下胰岛素泵输注；长效胰岛素

解析：本题考查1型糖尿病。患者，男，74岁，1型糖尿病30年，空腹血糖波动在2.9～9.1mmol/L，餐后2小时血糖波动在4.1～10.4mmol/L之间，该患者可长期应用的治疗药物有基础胰岛素加餐时胰岛素（B对）、持续皮下胰岛素泵输注（C对）、长效胰岛素（E对）。1型糖尿病患者由于自身无法分泌胰岛素，故需终身使用胰岛素治疗，且1型糖尿病患者禁用口服降糖药，故只能使用胰岛素。瑞格列奈（A错）为非磺酰脲类口服降糖药。艾塞那肽（D错）为胰高血糖素样肽-1受体激动剂，用于治疗2型糖尿病，采用注射给药。